根据阴挺的分度，宫颈外口距处女膜缘XI＜4cm，未达处女膜缘为
A. Ⅰ度轻型
B. Ⅰ度重型
C. Ⅱ度轻型
D. Ⅱ度重型
E. Ⅲ度

正确答案：A。Ⅰ度轻型

解析：Ⅰ度：子宫颈下垂到坐骨棘以下，但不超过阴道口。轻型：宫颈外口距处女膜缘＜4CM(A对)；重型：宫颈口已达处女膜缘（B错）。Ⅱ度：轻型宫颈口已经脱出阴道口（C错）；重型宫颈及部分宫体已脱出阴道口（D错）。Ⅲ度：宫颈及宫体全部脱出至阴道口外（E错）。